形神关系确切的是
A. 精能生神
B. 神附于形
C. 神为形主
D. 形为神宅
E. 形与神俱

正确答案：E。形与神俱

解析：形与神俱，即精气神合一，是生命活动的根本保证，形存则神存，形亡则神灭，如《素问•上古天真论》说：“故能形与神俱，而尽终其天年”（E对）。精能化神，神寓精中；精盈则神明，神安则精足（A错）。形为神之质，神为形之用（CD错）。